下列属于机会致病菌的是
A. 破伤风梭菌
B. 结核分枝杆菌
C. 白喉棒状杆菌
D. 无芽胞厌氧菌
E. 炭疽芽胞杆菌

正确答案：D。无芽胞厌氧菌

解析：无芽胞厌氧菌包括多种革兰氏阴性厌氧菌，如卟啉单胞菌属、梭杆菌属、放线菌属等，以及革兰阳性厌氧菌，如乳杆菌属、口腔链球菌属等细菌，它们大多属于人体正常菌群重要组成部分，其致病性不强，为机会性致病菌。掌握“无芽胞厌氧菌”知识点。